既益气，又除热止汗的药是
A. 浮小麦
B. 白芍
C. 麻黄根
D. 刺五加
E. 山茱萸

正确答案：A。浮小麦

解析：本题考查的是浮小麦的功效。既益气，又除热止汗的药是浮小麦（A对）。浮小麦：【功效】益气，除热止汗。白芍（B错）：【功效】养血调经，敛阴止汗，柔肝止痛，平抑肝阳。麻黄根（C错）：【功效】收敛止汗。刺五加（D错）：【功效】补气健脾，益肾强腰，养心安神，活血通络。山茱萸（E错）：【功效】补益肝肾，收敛固脱。